1岁小儿结核菌素试验阳性，可以推测患儿
A. 近2～3周感染结核
B. 体内已经有免疫力，不会再感染结核
C. 体内有活动结核
D. 对结核无免疫力，需立即接种卡介苗
E. 受过结核感染，不一定有活动结核

正确答案：C。体内有活动结核

解析：未接种卡介苗的小儿PPD阳性反应多表示体内有新的结核病灶，并且年龄越小，体内有活动结核（C对）的可能性就越大。1岁小儿的肺结核多见原发性肺结核（P192），即结核杆菌初次侵入肺部后发生的原发感染，可见题中未接种疫苗的小儿没有受过结核杆菌感染（E错），也并无免疫力（B错）。结核分枝杆菌感染4～8周后结核杆菌试验即才会表现出阳性反应（A错），这时的小儿不能接种卡介苗（D错）。